25岁已婚妇女，停经50天诊为早孕，要求行负压吸宫术。术中出现恶心呕吐、出汗，查体面色苍白，血压70/50mmHg，心率48次/分。本例的正确处理应是
A. 间断正压吸氧
B. 静脉注射止吐剂
C. 静脉注射阿托品
D. 静脉滴注抗生素
E. 静脉滴注升压药

正确答案：C。静脉注射阿托品

解析：该患者在术中出现恶心呕吐、出汗，面色苍白，血压下降，最可能的诊断是人工流产综合反应。由于出现血压下降，故该患者发生了严重的人工流产综合反应，应加用阿托品0.5-1mg静脉注射（C对）。间断正压吸氧（A错）是非严重者的处理方式。静脉注射止吐剂（B错）、静脉滴注抗生素（D错）、静脉滴注升压药（E错）均不是人工流产综合反应的处理。